以下哪种药物临床用于治疗各种类型的PD病人，但对吩噻嗪类所引起的帕金森综合征无效
A. 多西环素
B. 青霉素
C. 利福平
D. 利多卡因
E. 左旋多巴

正确答案：E。左旋多巴

解析：左旋多巴临床用于治疗各种类型的PD病人，不论年龄和性别差异和病程长短均适用，但对吩噻嗪类等抗精神病药所引起的帕金森综合征无效。掌握“左旋多巴、卡比多巴、苯海索”知识点。